寒证与热证相互转化的关键因素是
A. 邪气的性质
B. 邪气的进退
C. 邪正的对比
D. 阴液的盈亏
E. 阳气的盛衰

正确答案：E。阳气的盛衰

解析：寒证化热提示阳气旺盛，热证转寒提示阳气衰惫，所以寒证与热证相互转化的关键因素是阳气的盛衰(E对）。邪气的性质决定发病的类型（A错），邪气的进退决定疾病的进展方向（B错），邪正的对比决定了疾病的轻重（C错）。阴液的盈亏与寒热证转化无关（D错）。